对中、重度持续哮喘患者的长期维持治疗的推荐方案是
A. 吸入性糖皮质激素+长效β₂受体激动剂
B. 吸入性糖皮质激素+短效β₂受体激动剂
C. 长效β₂受体激动剂+长效M胆碱受体阻断剂
D. 长效M胆碱受体阻断剂+白三烯受体阻断剂
E. 长效β₂受体激动剂+白三烯受体阻断剂

正确答案：A。吸入性糖皮质激素+长效β₂受体激动剂

解析：本题考查给药方案设计。对中、重度持续哮喘患者的长期维持治疗的推荐方案是吸入性糖皮质激素+长效β₂受体激动剂（A对）。中、重度持续哮喘患者的长期维持治疗的推荐方案：吸入性糖皮质激素+长效β₂受体激动剂或长效M胆碱受体阻断剂（BC错）。白三烯受体阻断剂可应用于不同类型的哮喘患者，或单独应用于轻度、持续哮喘的治疗（DE错）。